牙隐裂好发于
A. 下颌第一磨牙
B. 上颌第一磨牙
C. 下颌第二磨牙
D. 上颌第二磨牙
E. 上颌前磨牙

正确答案：B。上颌第一磨牙

解析：本题考查牙隐裂的临床表现。牙隐裂好发于上颌第一磨牙（B对）。牙隐裂是指发生在牙冠表面的、不易被发现的细小裂纹。牙位以第一磨牙好发，其次是第二磨牙和前磨牙；部位以前磨牙和磨牙的颊侧颈部、上颌磨牙的近中腭尖等多见。症状有激发痛、咬合痛、自发痛等。疼痛程度与裂缝的深度相关。